某农村地区，农民家庭电视拥有率为20%，家家户户都可以收听到有线广播，广播内容有农村环境卫生、疾病预防等健康信息。如果主要选择电视为健康传播媒介即违背了媒介选择的
A. 保证效果原则
B. 针对性原则
C. 速度快原则
D. 可及性原则
E. 经济性原则

正确答案：D。可及性原则